阿司匹林是以下哪类药物的代表
A. 抗精神失常药
B. 抗癫痫药
C. 麻醉药
D. 镇痛药
E. 非甾体类抗炎药

正确答案：E。非甾体类抗炎药

解析：解热镇痛抗炎药是一类具有解热、镇痛，而且大多数还有抗炎、抗风湿作用的药物。鉴于其抗炎作用与糖皮质激素不同，故将这类药又称为非甾体抗炎药。阿司匹林是这类药物的代表，所以又被称为阿司匹林类药物。掌握“阿司匹林”知识点。